《中国药典》一部规定秦艽的含量测定成分是
A. 龙胆苦苷+马钱苷酸
B. 苦参碱+氧化苦参碱
C. 二苯乙烯苷+大黄素
D. 盐酸小檗碱+巴马汀
E. 阿魏酸+香草酸

正确答案：A。龙胆苦苷+马钱苷酸

解析：本题考查的是秦艽的含量测定。《中国药典》一部规定秦艽的含量测定成分是龙胆苦苷+马钱苷酸（A对）。秦艽【含量测定】按《中国药典》采用高效液相色谱法测定，本品含龙胆苦苷和马钱苷酸的总量不得少于2.5%。苦参【含量测定】按《中国药典》采用高效液相色谱法测定，本品含苦参碱和氧化苦参碱（B错）的总量不得少于1.20%；饮片不得少于1.0%。何首乌的主要成分为蒽醌类成分，以大黄素、大黄酚、大黄素甲醚、大黄酸、芦荟大黄素等为主，《中国药典》以二苯乙烯苷和结合蒽醌为指标成分对何首乌进行含量测定，要求何首乌含二苯乙烯苷不得少于1.0%，制何首乌含二苯乙烯苷（C错）不得少于0.70%；对何首乌和制何首乌要求结合蒽醌均不得少于0.10%（以大黄素和大黄素甲醚计）。黄连的有效成分主要是生物碱，已经分离出来的生物碱有小檗碱、巴马汀、黄连碱、甲基黄连碱、药根碱和木兰碱等。《中国药典》以小檗碱为指标成分对黄连进行含量测定。以盐酸小檗碱计，要求味连含小檗碱不得少于5.5%，表小檗碱不得少于0.80%，黄连碱不得少于1.6%，巴马汀（D错）不得少于1.5%；要求雅连含小檗碱不得少于4.5%；要求云连含小檗碱不得少于7.0%。当归中主要含有有机酸类成分、挥发油和多糖类成分。有机酸类成分主要包括阿魏酸、香草酸、烟酸和琥珀酸等。《中国药典》以阿魏酸和挥发油为指标成分对当归进行含量测定，要求阿魏酸（E错）含量不得少0.050%，挥发油含量不得少于0.4%（ml/g）。